下列各项，属于实热证的是
A. 头颅过大
B. 头颅过小
C. 囟填
D. 囟陷
E. 解颅

正确答案：C。囟填

解析：囟门突起被称为囟填，多因热邪炽盛所致，属于实热证（C对）。头大指头颅增大，颅缝开裂，颜面较小，智力低下，多因先天不足，肾精亏损，水液停聚于脑所致（A错）。头小指头颅狭小，头顶尖圆，颅缝早合，智力低下，多因肾精不足，颅骨发育不良所致（B错）。囟陷即囟门凹陷，多属虚证，多因吐泻伤津，气血不足和先天肾精亏虚、脑髓失充所致（D错）。解颅即囟门迟闭，骨缝不合，此为先天肾精不足，或后天脾胃虚弱，发育不良的表现，多见于佝偻病患儿（E错）。